女性，21岁，因发热、干咳、乏力20天，咯血2天入院。查体：T38.5℃，消瘦，右上肺触觉语颤增强，叩诊浊音，可闻及支气管呼吸音。PPD（1单位）硬结20mm，表面有水泡。X线胸片于右上2～4前肋处见密度高，浓淡不均阴影。最可能的诊断是
A. 右上肺癌
B. 右上肺结核
C. 右上包裹性积液
D. 右上大叶性肺炎
E. 右上支气管扩张症

正确答案：B。右上肺结核

解析：患者为青年女性，发热干咳乏力20天，咯血2天伴消瘦，右上肺触觉语颤增强叩诊浊音可闻及支气管呼吸音，PPD（1单位）硬结20mm，表面有水泡（PPD结核菌素皮肤试验：72小时后观察注射部位皮肤硬结直径：直径5～9mm为弱阳性；10～19mm为阳性反应，提示结核杆菌感染；硬结节直径≥20mm或＜20mm但有水疱或坏死为强阳性，提示活动性结核病可能），X线胸片于右上2-4前肋处见密度高，浓淡不均阴影，根据其临床表现和辅助检查，考虑诊断为右上肺结核（B对）。右上肺癌（A错）、右上包裹性积液（C错）、右上大叶性肺炎（D错）、右上支气管扩张症（E错）均不会出现PPD试验强阳性。